某化工厂清釜工在定期体检时发现多名工人肝脾大，其中一名诊断为肝血管肉瘤，此化工厂可能生产
A. 氯乙烯
B. 氯甲醚
C. 甲醛
D. 己内酰胺
E. 苯

正确答案：A。氯乙烯